某男，21岁，咳嗽10余日，痰多，咽痛音哑，证属肺气不宣、痰浊阻肺，宜选用的药是
A. 桔梗
B. 葶苈子
C. 紫菀
D. 紫苏子
E. 款冬花

正确答案：A。桔梗

解析：本题考查的是桔梗的主治病证。咳嗽10余日，痰多，咽痛音哑，证属肺气不宣、痰浊阻肺，宜选用的药是桔梗（A对）。桔梗：【主治病证】（1）咳嗽痰多、咯痰不爽，咽痛音哑。（2）肺痈胸痛、咳吐脓血、痰黄腥臭。葶苈子（B错）：【主治病证】（1）痰壅肺实之咳喘。（2）浮肿尿少，小便不利。紫菀（C错）：【主治病证】（1）外感咳嗽、咳痰不爽。（2）肺虚久咳、痰中带血。紫苏子（D错）：【主治病证】（1）痰壅咳喘气逆。（2）肠燥便秘。款冬花（E错）：【主治病证】多种咳嗽。